在分析某人群中疾病的发生频率时，首先需考虑的个体因素是
A. 性别
B. 年龄
C. 民族
D. 血型
E. 宗教

正确答案：B。年龄

解析：本题考查年龄因素在疾病中的影响。年龄（B对ACDE错）是人群最主要的人口学特征之一，几乎所有疾病的发生及发展均与年龄有相当密切的关系。研究疾病的年龄分布，有助于深入认识疾病的分布规律，探索流行因素，为病因研究和疾病的预防与控制提供基本线索。